雷丸用于驱虫，宜
A. 研末服
B. 与其他药同煎
C. 另炖
D. 先煎
E. 后下

正确答案：A。研末服

解析：本题考查的是雷丸的用法用量。雷丸用于驱虫，宜研末服（A对）。雷丸：【用法用量】内服：15～21g，不宜入煎剂，一般研粉或入丸剂，每次5～7g（驱杀绦虫每次12～18g），饭后用温开水调服，每日3次，连服3天。与其他药同煎（B错）为未特殊说明用法用量的中药的用法。羚羊角：【用法用量】内服：煎汤，1～3g，宜另煎（C错）2小时以上，与煎好的药液合兑；磨汁或挫末，每次0.3～0.6g；也可入丸散。自然铜：【用法用量】内服：煎汤，3～9g，打碎先煎（D错）；或醋淬研细末入散剂，每次0.3g。外用：适量，研末调敷。薄荷：【用法用量】内服：煎汤，2～10g；或入丸散；不宜久煎，入汤剂当后下（E错）。外用：适量，鲜品捣敷或捣汁涂，也可煎汤洗或含漱。其叶长于发汗，梗偏于理气。